除另有规定外，儿科用散剂应为
A. 中粉
B. 细粉
C. 最细粉
D. 极细粉
E. 超细粉

正确答案：C。最细粉

解析：本题考查散剂的质量要求。除另有规定外，儿科用散剂应为最细粉（C对）。散剂质量要求：供制备散剂的原料药均应粉碎。除另有规定外，内服散剂应为细粉（B错）；儿科及局部用散剂应为最细粉；眼用散剂应为极细粉（D错），且应无菌。按照《中国药典》要求，细粉系指能全部通过五号筛，并含能够通过六号筛不少于95%的粉末；最细粉系指能全部通过六号筛，并含能够通过七号筛不少于95%的粉末；极细粉系指能全部通过八号筛，并含能够通过九号筛不少于95%的粉末。中粉（A错）：能全部通过四号筛，但混有能通过五号筛不超过60%的粉末。超微粉碎：超微粉碎技术是20世纪70年代后发展起来的一种物料加工高新技术，也是古老粉碎技术的新应用和新发展。超微粉碎又称超细粉碎，是指将粉粒物料磨碎到粒径为微米级以下的操作。超微粉体又称超细粉（E错）体，通常分为微米级、亚微米级以及纳米级粉体。粉体粒径为1～100nm的称为纳米粉体；粒径为0.1～1㎛的称为亚微米粉体；粒径大于1㎛的称为微米粉体。